对于某一诊断为“震颤麻痹”的患者，以下可供选择的药物哪项是错误的
A. 氯丙嗪
B. 苯海索
C. 金刚烷胺
D. 左旋多巴
E. 溴隐亭

正确答案：A。氯丙嗪